Curling溃疡的病因是
A. 酒精
B. 幽门螺杆菌感染
C. 严重烧伤
D. 中枢神经系统严重损伤
E. 非甾体抗炎药

正确答案：C。严重烧伤

解析：Curling溃疡的病因是严重烧伤（C对）。酒精（A错）和非甾体抗炎药（E错）可导致急性胃炎。幽门螺旋杆菌常是消化性溃疡的致病因素（B错）。中枢神经系统严重损伤（D错）常引起Cushing溃疡。